木瓜所含的化学成分有
A. 皂苷
B. 黄酮类
C. 有机酸
D. 鞣质
E. 维生素C

正确答案：A、B、C、D、E。皂苷；黄酮类；有机酸；鞣质；维生素C